患者，女性，65岁，因阵发性胸闷8年，持续胸痛8小时收入院。入院时血压为150/90mmHg，诊断急性前壁心肌梗死。起病4周后，病人反复低热，左肺底有湿性啰音，心前区闻及心包摩擦音，此时应考虑并发
A. 肺结核
B. 尿毒症
C. 感染性心内膜炎
D. 心肌梗死后综合征
E. 肺栓塞

正确答案：D。心肌梗死后综合征

解析：患者老年女性，持续胸痛8小时，诊断急性前壁心肌梗死。起病4周后，出现低热，左肺底有湿性啰音（肺炎体征），心前区闻及心包摩擦音（急性心包炎特异性体征），此时应考虑并发心肌梗死后综合征（D对）。肺结核（P65）（A错）虽有反复低热，但好多伴有咳嗽、咳痰或痰中带血，夜间盗汗，食欲减退等症状。尿毒症（B错）为慢性肾衰竭的终末期，多伴有水、钠平衡紊乱和代谢性酸中毒等肾功能不全表现。感染性心内膜炎（C错）也可出现长期低热，但会出现心脏可变杂音，一般不会有心包摩擦音。肺栓塞（E错）患者常突发不明原因的呼吸困难及气促，并可伴胸痛、咳血等体征。